可致男性胎儿外生殖器发育畸形，妊娠期或备孕期妇女不宜接触其破碎制剂的药物是
A. 非那雄胺
B. 赛洛多辛
C. 特拉唑嗪
D. 多沙唑嗪
E. 坦洛新

正确答案：A。非那雄胺

解析：本题考查非那雄胺的不良反应。可致男性胎儿外生殖器发育畸形，妊娠期或备孕期妇女不宜接触其破碎制剂的药物是非那雄胺（A对）。妊娠期妇女或备妊娠妇女不要接触破碎非那雄胺片剂，因可能被皮肤吸收继而导致男性胎儿畸形，也不要接触服用该类药物的男性伴侣的精液。坦洛新（E错）和赛洛多辛（B错）的FDA的妊娠期药物危险分类为B类，但仅限于治疗BPH，无女性使用的适应证。常见不良反应有头痛和眩晕，射精异常，如射精失败、射精减少和逆行射精。特拉唑嗪（C错）、多沙唑嗪（D错）属于α受体阻断剂，可降低外周血管阻力，对心输出量影响不大，起效快，作用强，临床应用于顽固性高血压，会引起体位性低血压，尤其在服药0.5～2h最易发生，表现为严重体位性低血压、眩晕、晕厥等。